在健康教育学的研究方法中，德尔菲法属于
A. 观察法
B. 实验研究
C. 准实验研究
D. 调查法
E. 其他实验方法

正确答案：D。调查法